治疗铜绿假单胞菌感染宜选用
A. 双氯西林
B. 替卡西林
C. 阿莫西林
D. 青霉素V
E. 氨苄西林

正确答案：B。替卡西林

解析：本题考查半合成青霉素。抗铜绿假单胞菌青霉素包括羧苄西林、磺苄西林（耐酸、不耐酶）、替卡西林（B对）。酰脲类青霉素包括哌拉西林、美洛西林、阿洛西林。该类药物的特点为对革兰阴性杆菌尤其是铜绿假单胞菌有较强作用，部分药物可口服。双氯西林（A错）为耐酸耐酶青霉素。阿莫西林（C错）和氨苄西林（E错）为广谱青霉素。青霉素V（D错）为耐酸青霉素。